患者鼓胀，腹大胀满，形似蛙腹，朝宽暮急，面色苍黄或白，脘闷纳呆，神倦怯寒，肢冷浮肿，小便短少不利，舌体胖，质紫，苔淡白，脉沉细无力其中医治法为
A. 清热利湿，攻下逐水
B. 温补脾肾，化气利水
C. 活血化瘀，行气利水
D. 温中健脾，行气利水
E. 疏肝理气，运脾利湿

正确答案：B。温补脾肾，化气利水

解析：患者病为鼓胀，又根据其临床表现如腹大胀满，朝宽暮急，神倦怯寒，肢冷浮肿，小便短少不利等可判断患者为鼓胀之脾肾阳虚证，治宜温补脾肾，化气利水（B对）。